上纵隔器官不包括
A. 胸腺
B. 主动弓
C. 心
D. 上腔静脉
E. 气管

正确答案：C。心

解析：上纵隔内有胸腺（A对）、主动脉弓（B对）、上腔静脉（D对）、气管（E对）等，没有心（C错，为本题正确答案）”。